患者，男，25岁，自述后牙咀嚼无力，检查下颌后磨牙缺失，其余牙体健康，但牙齿排列不齐，口腔卫生差，牙石（+++）。修复前口腔的一般处理为
A. 洁治
B. 正畸治疗
C. 心理辅导
D. 调磨牙尖
E. 余留牙拔除

正确答案：A。洁治

解析：本题考查修复前准备。保证良好的口腔卫生：口腔卫生状况直接关系到牙龈、牙周组织的健康以及修复效果和修复体的使用寿命。同时，牙结石、软垢等在牙面上的大量附着，将影响印模的准确性，所以修复前对牙结石和软垢应彻底洁治（A对）清除。